结核性脑膜炎典型的脑脊液改变是
A. 压力增高
B. 外观呈毛玻璃样
C. 白细胞增多，分类以淋巴细胞为主
D. 糖及氯化物含量同时减低
E. 蛋白量增高

正确答案：D。糖及氯化物含量同时减低